高血压合并痛风不宜选用的药物是
A. 缬沙坦
B. 美托洛尔
C. 贝那普利
D. 氢氯噻嗪
E. 硝苯地平控释片

正确答案：D。氢氯噻嗪

解析：痛风是由单钠尿酸盐沉积所致的晶体相关性关节病，与嘌呤代谢紊乱和（或）尿酸排泄减少所致的高尿酸血症直接相关。氢氯噻嗪（D对）利尿剂会影响血脂、血糖、血尿酸的代谢，加重痛风。缬沙坦（A错）主要作用为交感神经抑制剂。美托洛尔（B错）作用机制为抑制中枢和周围RAAS，抑制心肌收缩力和减慢心律。贝那普利（C错）为血管紧张素转化酶抑制剂，主要通过抑制循环和组织ACE。硝苯地平控释片（E错）为钙通道阻滞剂，通过减弱兴奋-收缩偶联，降低阻力血管的收缩。